属于高警示药品的是
A. 人促红素注射液
B. 高锰酸钾外用片
C. 0.9%氯化钠注射液
D. 肠内营养制剂
E. 硝酸甘油片

正确答案：B。高锰酸钾外用片

解析：本题考查高警示药品的管理。13种高警示药品品种包括阿片酊；阿托品注射液（规格≥5mg/支）；高锰酸钾外用制剂（B对）；加压素（静脉注射或骨髓腔内注射）；甲氨蝶呤（口服，非肿瘤用途）；硫酸镁注射液；浓氯化钾注射液；凝血酶冻干粉；肾上腺素（皮下注射）；缩宫素（静脉注射）；注射用硝普钠；异丙嗪（静脉注射）；注射用三氧化二砷。